小儿腹泻的定义是
A. 多为轮状病毒感染致秋季腹泻
B. 星状病毒感染致腹泻
C. 致病性大肠杆菌感染致腹泻
D. 食饵性腹泻
E. 多病原，多因素引起的大便次数增多和性状改变

正确答案：E。多病原，多因素引起的大便次数增多和性状改变

解析：腹泻病的定义是一组由多病原、多因素引起的以大便次数增多和大便性状改变为特点的消化道综合征（E对），很多病原体都会导致腹泻病的发生，其中轮状病毒肠炎是婴儿腹泻最常见病原（A错），星状病毒感染致腹泻（B错）、致病性大肠杆菌感染致腹泻（C错）、食饵性腹泻（D错）是婴儿腹泻病的常见病因但不能作为小儿腹泻的定义。